龈上边缘的主要优点是
A. 边缘密合
B. 美观
C. 牙周刺激小
D. 不易菌斑附着
E. 以上都不是

正确答案：C。牙周刺激小

解析：本题考查龈上边缘的优点。龈上边缘的主要优点是牙周刺激小（C对）。龈上边缘位于牙槽嵴顶以上，不与牙龈接触，有以下优点：1.边缘的牙体预备时不容易损伤牙龈；2.印模制取方便，不用排龈；3.有利于牙周健康；4.容易检查边缘的密合度等。龈上边缘位于龈上，故美观性差（B错）；肩台边缘距离牙龈有一定距离，故备牙时不易损伤牙龈，对牙周的刺激小，有利于牙周健康。边缘位于龈上，可直视，故容易检查边缘密合度，但是边缘密合（A错）的好坏是通过明确的肩台预备、精确的取模和制作实现，与龈边缘的位置无关。菌斑附着的难易与牙面、边缘的光滑程度有关（D错），龈上边缘的位置确实会减少食物沉积，利于清洁，减少菌斑附着，但这不是主要优点。